可用作油脂性栓剂基质的是
A. 卵磷脂
B. 半合成（山苍子油脂）
C. 甘油明胶
D. 乙基纤维素
E. 十二烷基苯磺酸钠

正确答案：B。半合成（山苍子油脂）

解析：本题考查的是栓剂的基质类型。可用作油脂性栓剂基质的是半合成（山苍子油脂）（B对）。栓剂的基质主要分为油脂性和水溶性基质。1.油脂性基质：（1）可可豆脂：常温下为黄白色固体，可塑性好，无刺激性，能与多种药物配伍使用。熔点为31℃～34℃，加热至25℃开始软化，在体温即能迅速融化，10℃～20℃时易粉碎成粉末。（2）半合成脂肪酸甘油酯类：本类基质不易酸败，贮藏中也比较稳定，为目前应用较多的油脂性栓剂基质，其中有半合成椰子油酯、半合成山苍子油酯、半合成棕榈油酯等。2.水溶性基质：（1）甘油明胶（C错）：系用明胶、甘油与水制成，一般明胶与甘油等量，水应控制在10%以下。具有弹性，不易折断，在体温下能软化并缓慢溶于分泌液中。（2）聚乙二醇类：聚乙二醇1000、4000、6000的熔点分别为38℃～40℃、53℃～56℃、55℃～63℃，以两种或两种以上的聚乙二醇加热熔融可制得理想硬度和释药速度的栓剂基质。本类基质在体温条件下不熔化，能缓缓溶于直肠液中，但对黏膜有一定刺激性。卵磷脂（A错）为两性离子表面活性剂。两性离子表面活性剂：本类表面活性剂的分子结构中同时含有阴阳离子基团，在不同pH介质中可表现出阴离子或阳离子表面活性剂的性质。①天然的两性离子表面活性剂：主要有豆磷脂和卵磷脂。②合成的两性离子表面活性剂：本类表面活性剂的阴离子部分主要是羧酸盐，阳离子部分主要是胺盐或季铵盐。乙基纤维素（D错）为涂膜剂的成膜材料。涂膜剂常用的成膜材料有聚乙烯醇、聚乙烯吡咯烷酮、乙基纤维素和聚乙烯醇缩甲乙醛等；增塑剂有甘油、丙二醇、三乙酸甘油酯等；溶剂为乙醇等。必要时可加其他附加剂，所加附加剂对皮肤或黏膜应无刺激性。十二烷苯基磺酸钠（E错）为阴离子表面活性剂。阴离子表面活性剂：本类表面活性剂起表面活性作用的是阴离子。主要包括高级脂肪酸盐、硫酸化物以及磺酸化物。①高级脂肪酸盐：又称肥皂类。②硫酸化物：为硫酸化油和高级脂肪醇的硫酸酯类。常用的有：a.硫酸化蓖麻油，俗称土耳其红油；b.高级脂肪醇硫酸酯类，如有十二烷基硫酸钠（又称月桂醇硫酸钠）。③磺酸化物：主要有脂肪族磺酸化物、烷基芳基磺酸化物、烷基萘磺酸化物等。常用的有：a.脂肪族磺酸化物，如二辛基琥珀酸磺酸钠（商品名“阿洛索-OT”）等；b.烷基芳基磺酸化物，如十二烷基苯磺酸钠。